诊断伤寒血常规检查最有意义的是
A. 嗜碱性粒细胞计数
B. 血小板计数
C. 血白细胞计数
D. 红细胞计数
E. 嗜酸性粒细胞计数

正确答案：E。嗜酸性粒细胞计数

解析：伤寒患者血常规检查白细胞计数一般在（3～5）×10⁹/L之间，中性粒细胞减少，可能与骨髓的粒细胞系统受到细菌毒素的抑制、粒细胞的破坏增加和分布异常有关。嗜酸性粒细胞减少或消失，病情恢复后逐渐回升到正常，复发时再度减少或消失。嗜酸性粒细胞计数对诊断和评估病情均有重要的参考意义（E对）。